妊娠合并糖尿病终止妊娠的最佳时间是
A. 妊娠34～35周
B. 妊娠35～36周
C. 妊娠36～37周
D. 妊娠37～38周
E. 妊娠38～39周

正确答案：E。妊娠38～39周